治疗血热妄行，应首选
A. 生地黄
B. 玄参
C. 牡丹皮
D. 赤芍
E. 羚羊角

正确答案：A。生地黄

解析：生地黄苦寒入营血分，为清热，凉血，止血之要药，是治疗血热妄行之药的首选（A对）。玄参、牡丹皮、赤芍性皆微寒，均有清热凉血的功效，非治疗血热妄行之药的首选（BCD错）。羚羊角入心肝二经，长于息风止痉、清泻肝火，非治疗血热妄行之药的首选（E错）。